引起亚急性硬化性全脑炎（SSPE）的病原体是
A. 风疹病毒
B. 麻疹病毒
C. 轮状病毒
D. 腮腺炎病毒
E. 流感病毒

正确答案：B。麻疹病毒